属于气血两虚临床表现的是
A. 唇甲色淡，胁下痞块，拒按，舌暗，脉沉涩
B. 胸胁胀闷窜痛，时轻时重，舌苔薄白，脉弦
C. 两胁胀闷窜痛，胁下痞块，舌略紫，脉涩
D. 面唇色淡白，疲乏无力，自汗，脉弱
E. 少气懒言，疲乏无力，自汗，舌淡，脉弱

正确答案：D。面唇色淡白，疲乏无力，自汗，脉弱

解析：“气血两虚证，指气虚和血虚的证候兼并出现，临床以少气懒言，神疲乏力，自汗；面色淡白无华或萎黄，口唇、爪甲颜色淡白，或见心悸失眠，头晕目眩，形体消瘦，手足发麻；舌质淡白，脉细无力等为辨证依据”，本题临床表现与之相符，面唇色淡白，为血虚表现，是由血液亏虚，无以上荣面部所致；疲乏无力，自汗，为气虚表现，是由气虚致脏腑功能减退，卫外不固所致，故选项面唇色淡白，疲乏无力，自汗，脉弱，属于气血两虚的临床表现（D对）。唇甲色淡，为血虚表现，是由血液亏虚，脉络空虚，形体组织缺乏濡养荣润所致；胁下痞块，拒按，舌暗，脉沉涩，为血瘀表现，是由于血液淤积不散，不通则痛所致，故选项唇甲色淡，胁下痞块，拒按，舌暗，脉沉涩，属于血虚兼血瘀证的临床表现（A错）。胸胁胀闷窜痛，时轻时重，舌苔薄白，脉弦，为气滞的表现，是由气的运行发生障碍，气机不畅则胀闷，障碍不通则疼痛，气得运行则症减所致，故选项胸胁胀闷窜痛，时轻时重，舌苔薄白，脉弦，属于气滞证的临床表现(B错)。两胁胀闷窜痛，为气滞表现，是由气机运行不畅所致；胁下痞块，舌略紫，脉涩，为血瘀表现，是由血液瘀积不行所致，故选项两胁胀闷窜痛，胁下痞块，舌略紫，脉涩，属于气滞血瘀的临床表现（C错）。少气懒言，疲乏无力，自汗，舌淡，脉弱，为气虚的表现，是由气虚致脏腑功能衰退，卫外不固所致，故选项少气懒言，疲乏无力，自汗，舌淡，脉弱，属于气虚证的临床表现（E错）。